面部呆板、无表情，似面具样，见于
A. 破伤风
B. 震颤麻痹
C. 甲亢患者
D. 肝硬化
E. 二尖瓣狭窄

正确答案：B。震颤麻痹

解析：面部呆板、无表情，似面具样，是面具面容，见于震颤麻痹等（B对）。破伤风可见苦笑面容，为一种病态面容，即面部肌肉痉挛时，表面牙关紧闭，面部肌肉紧张挛缩，貌似苦笑状(A错)。甲亢患者可见甲亢面容，表现为眼裂加宽、眼球突出，情绪易激动，常兴奋不安，目光闪烁，表情惊愕等（C错）。肝硬化可见肝病面容，表现为面色苍黄无华或青黯，面部片状色素斑块，面容憔悴，面、颈、上胸、背、两肩及上肢可见蜘蛛痣或毛细血管扩张（D错）。二尖瓣狭窄可见二尖瓣面容，表现为脸颊颧骨部位粉红色而嘴唇发紫（E错）。